细胞静息电位为-90mV，当其受到刺激后变为-100mV时的膜电位变化称为
A. 极化
B. 复极化
C. 超极化
D. 反极化
E. 去极化

正确答案：C。超极化

解析：超极化（C对）为膜的极化状态增强的状态，表现为静息电位增大，如细胞静息电位为-90mV，当其受到刺激后变为-100mV。极化（A错）为安静时细胞膜两侧处于外正内负的状态。复极化（B错）为细胞膜去极化后再向静息电位方向恢复的过程。反极化（D错）为去极化至零电位后膜电位进一步变为正值，使膜两侧电位的极性与原来的极化状态相反的状态。去极化（E错）为膜的极化状态减弱的状态，表现为静息电位减小（如细胞内电位由-70mV变为-50mV）。